大隐静脉叙述错误的是
A. 是全身最长的静脉
B. 直接注入下腔静脉
C. 沿小腿和大腿的内侧上行
D. 穿隐静脉裂孔注人股静脉
E. 经过内踝前方

正确答案：B。直接注入下腔静脉

解析：大隐静脉是全身最长的静脉（A对）。穿阔筋膜的隐静脉裂孔注入股静脉（D对B错，为本题正确答案）。沿小腿内侧面、膝关节内后方、大腿内侧面（C对）上行。经过内踝前方（E对）。